下列关于颌面部后天梅毒的表现叙述中，不正确的是
A. 腭部树胶样肿常位于腭中线
B. 口唇下疳
C. 梅毒疹
D. 腭部树胶样肿波及鼻中隔、鼻骨、上颌骨
E. 梅毒树胶样肿以上颌切牙牙槽突、鼻中隔最常见

正确答案：E。梅毒树胶样肿以上颌切牙牙槽突、鼻中隔最常见

解析：后天梅毒：依病程主要表现有三点，即口唇下疳、梅毒疹和树胶样肿（梅毒瘤）。梅毒树胶样肿除累及软组织外，还可累及颌面骨及骨膜组织。以硬腭部最常见，其次为上颌切牙牙槽突、鼻中隔。腭部树胶样肿常位于腭中线（有时原发于鼻中隔）。腭部树胶样肿波及鼻中隔、鼻骨、上颌骨，可在颜面部表现为鞍状鼻。掌握“颌面部梅毒”知识点。